根据《药品类易制毒化学品管理办法》关于麦角新碱的说法，错误的是
A. 药品批发企业应建立专用账册，实行双人双锁管理
B. 麦角新碱属于第二类易制毒化学品
C. 购买麦角新碱原料药须取得《药品类易制毒化学品购用证明》
D. 医疗机构如果需要购进麦角新碱，应提供《麻醉药品第一类精神药品购用印鉴卡》的复印件

正确答案：B。麦角新碱属于第二类易制毒化学品

解析：本题考查药品类易制毒化学品。麦角新碱属于第一类易制毒化学品（B错，为本题正确答案）。药品类易制毒化学品的品种与分类：易制毒化学品分为三类。第一类是可以用于制毒的主要原料，第二类、第三类是可以用于制毒的化学配剂。药品类易制毒化学品属于第一类易制毒化学品。易制毒化学品分类和品种是由国务院批准调整，涉及药品类易制毒化学品的，是由国家药品监督管理部门负责及时调整并予公布。目前，药品类易制毒化学品分为两类，即：麦角酸和麻黄素等物质。药品类易制毒化学品品种目录（2010版）所列物质有：（1）麦角酸；（2）麦角胺；（3）麦角新碱；（4）麻黄素、伪麻黄素、消旋麻黄素、去甲麻黄素、甲基麻黄素、麻黄浸膏、麻黄浸膏粉等麻黄素类物质。（麻黄素也称为麻黄碱）。需要说明两点：一是上述所列物质包括可能存在的盐类；二是药品类易制毒化学品包括原料药及其单方制剂。药品类易制毒化学品生产企业、经营企业和使用药品类易制毒化学品的药品生产企业，应建立药品类易制毒化学品专用账册。用账册保存期限应当自药品类易制毒化学品有效期期满之日起不少于2年。存放药品类易制毒化学品的专库或专柜实行双人双锁管理（A对），药品类易制毒化学品入库应当双人验收，出库应当双人复核，做到账、物相符。国家对药品类易制毒化学品实行购买许可制度。购买药品类易制毒化学品的，应当办理《药品类易制毒化学品购用证明》（C对），符合豁免办理《购用证明》情形（详见《药品类易制毒化学品管理办法》第21条）的除外。药品类易制毒化学品的购买方为医疗机构的，档案应当包括医疗机构麻醉药品、第一类精神药品购用印鉴卡复印件和销售记录（D对）。